患者，女，出生后即被发现双侧上唇裂开。诊断为“先天性双侧唇裂，混合型”。其临床表现应该是
A. 双侧裂隙均未裂至鼻底
B. 双侧上唇至鼻底完全裂开
C. 合并其他面裂
D. 合并双侧牙槽嵴裂
E. 一侧完全，另一侧不完全唇裂

正确答案：E。一侧完全，另一侧不完全唇裂

解析：双侧唇裂：双侧不完全性唇裂（双侧裂隙均未裂至鼻底）；双侧完全性唇裂（双侧上唇至鼻底完全裂开）；双侧混合性唇裂（一侧完全裂，另一侧不完全裂）掌握“唇裂”知识点。